男性患者，40岁，肝硬化腹水数天，大量利尿后出现嗜睡，多语，四肢有时抽搐，呼吸14次/分，血pH：7.5，CO₂CP：30mmol/L；HCO₃⁻：3lmmol/L，K⁺：3mmoL/L，Cl⁻：90mmol/L，Na⁺：145mmol/L，Ca²⁺：3.5mmol/L，尿PH5.0。患者目前应是下列哪种情况
A. 肝硬化并发肝性脑病前期
B. 肝硬化并发肝癌
C. 肝硬化肝昏迷并发低钙血症
D. 肝硬化并发肝肾综合征
E. 肝硬化并发代谢性低钾低氯碱中毒

正确答案：E。肝硬化并发代谢性低钾低氯碱中毒

解析：中年男性患者，有肝硬化病史，腹水，大量利尿后出现嗜睡，多语，四肢抽搐，呼吸减慢，血气分析示：pH7.5（正常pH7.35～7.45），CO₂CP：30mmol/L（正常值35～45mmol/L）；HCO₃⁻：3lmmol/L（标准HCO₃⁻正常值23.3～24.8mmol/L，实际HCO₃⁻正常值22～26mmol/L），K⁺：3mmoL/L（正常值3.5～5.5mmoL/L），Cl⁻：90mmol/L（正常值96～106mmol/L），Na⁺：145mmol/L（正常值135～145mmol/L），Ca²⁺：3.5mmol/L（正常值2.25～2.75mmol/L）；分析患者血气分析可知，患者血pH值低于正常值，HCO₃⁻增加，CO₂CP＞29mmol/L，血清Cl⁻、血清K⁺常降低，为代谢性低钾低氯碱中毒故，患者为肝硬化并发代谢性低钾低氯碱中毒（E对）。肝性脑病前期，即潜伏期至昏迷前期，起初其无行为、性格的异常，无神经系统病理征，后逐渐出现意识障碍、睡眠障碍及行为反常，可出现嗜睡与兴奋交错，病理征阳性（A错）。肝癌患者实验室查甲胎蛋白明显升高（B错）。患者示嗜睡状态，并未出现昏迷，血钙高于正常值（C错）。肝肾综合征是指在严重肝病示发生的功能性急性肾功能衰竭，此患者并无肾衰竭证据（D错）。